完全随机设计的多个样本均数比较，经方差分析，若P≤a，则结论为
A. 各样本均数全相等
B. 各样本均数全不相等
C. 至少有两个样本均数不等
D. 至少有两个总体均数不等
E. 各总体均数全相等

正确答案：D。至少有两个总体均数不等